可以直接转变为谷氨酸的是
A. α-酮戊二酸
B. 乙酰乙酸
C. 肌醇
D. 胆汁酸
E. 琥珀酰CoA

正确答案：A。α-酮戊二酸

解析：可以直接转变为丙氨酸的是α-酮戊二酸（A对），它是谷氨酸相对应的α-酮酸，α-酮戊二酸与氨结合可以生成谷氨酸。乙酰乙酸（B错）是酮体的一种，可以转化为乙酰CoA供能。肌醇（C错）和胆汁酸（D错）都是脂质，脂类物质不能直接转变为氨基酸。琥珀酰CoA（E错）可以氧化供能、异生为糖或生成卟啉类化合物。